可用“离合出入”来概括其循行特点的是
A. 十五别络
B. 十二经别
C. 十二经脉
D. 十二经筋
E. 奇经八脉

正确答案：B。十二经别

解析：十二经脉的别络从肘膝关节以下分出后，阴经的别络均络于阳经，阳经的别络均络于阴经。别络循行于四肢，或上行头面，或进入躯干，与内脏有某些联系，但均没有固定的属络关系（A错）。十二经别循行，多从四肢肘膝以上部位别出，称为“离”；走入体腔脏腑深部，呈向心性循行，称为“入”；然后浅出体表，而上头面，称为“出”；阴经的经别合于相表里的阳经经别，然后一并注入六条阳经，称为“合”，每一对相表里的经别组成一合，十二经别分手足阴、阳组成六对，称为“六合”（B对）。十二经脉左右对称分布于人体两侧，每条经脉虽有迂回曲折，或交叉出入，但基本上为纵行，或自上而下，或由下而上（C错）。十二经筋的循行特点可以用"结、聚、散、络"加以概括。指十二经筋起于四肢末端，盘旋结聚于关节，布于胸背，终于头身（D错）。奇经八脉走向和分布特点：①除带脉外，均自下向上走行。②奇经八脉纵横交错地循行分布于十二经脉之间，但上肢没有奇经的分布。③冲（除小部分外）、任、督、带四脉都是单行一条。④阴阳跷脉和阴阳维脉分布左右对称（E错）。